我国对待新冠肺炎密切接触者采取的措施为
A. 留验
B. 预防治疗
C. 疫苗
D. 消毒
E. 居家隔离

正确答案：A。留验

解析：留验（A对）是指禁止某些传染病的接触者在该病最长潜伏期内自由行动，即医学观察，是我国对待新冠肺炎密切接触者采取的措施。预防治疗（B错）一般分为三级预防，每级预防的对象都不同。疫苗（C错）一般用于治疗未感染人群等。消毒（D错）一般可见于对传染病患者的分泌物、排泄物、污染物品、敷料等的处理。居家隔离（E错）一般适用于传染病高发地人群迁移的处理。